与氟胞嘧啶合用可增强艾滋病患者隐球菌性脑膜炎的疗效的是
A. 氟康唑
B. 利巴韦林
C. 异烟肼
D. 甲硝唑
E. 多西环素

正确答案：A。氟康唑

解析：氟康唑是治疗艾滋病患者隐球菌性脑膜炎的首选药，与氟胞嘧啶合用可增强疗效。掌握“氟康唑、利巴韦林及阿昔洛韦”知识点。